女，30岁。G2P1。既往月经规律，月经量少。身体健康。要求长期采取避孕措施。首选的避孕方法是
A. 宫内节育器
B. 紧急避孕药
C. 安全期避孕药
D. 长效口服避孕药
E. 外用杀精子剂

正确答案：A。宫内节育器

解析：该妇女为育龄期妇女，G2P1（孕2产1），既往月经规律，月经量少。身体健康。要求长期避孕，各种避孕方法（宫内节育器、皮下埋植剂、复方口服避孕药、避孕针、阴茎套等）均适用，但首选的避孕方法是宫内节育器（A对）。外用杀精子剂（P381）（E错）使用失误失败率高达20%以上，不作为避孕首选。长效口服避孕药（P378）（D错）激素含量大，副作用多，如早孕反应、月经失调等，市场上已经很少见。紧急避孕药（B错）仅对一次无保护性生活有效，避孕有效率明显低于常规避孕方法，且紧急避孕药激素剂量大，副作用亦大，不能代替常规避孕。安全避孕药（C错）又称自然避孕法，并不十分可靠，不宜推广。